24岁初孕妇。妊娠33周，头痛6天，经检查血压：160/110mmHg，治疗3天无显效。今晨5时突然出现剧烈腹痛。检查子宫板状硬。最可能的诊断是
A. 妊娠合并急性阑尾炎
B. 胎盘早剥
C. 前置胎盘
D. 先兆子宫破裂
E. 先兆早产

正确答案：B。胎盘早剥

解析：24岁初孕妇，妊娠33周（属于妊娠晚期），头痛6天，经检查血压：160/110mmHg（胎盘早剥的发生与孕妇血管病变有关，如妊娠期高血压疾病，尤其是重度子痫前期），今晨5时突然出现剧烈腹痛，检查子宫板状硬（胎盘早剥可出现突发持续性腹痛，Ⅲ度胎盘早剥腹部检查子宫板状硬）。综合患者的病史、症状及体征可诊断为胎盘早剥（Ⅲ度）（B对）。妊娠合并急性阑尾炎（A错）时无明显的转移性右下腹痛，白细胞计数会升高（P98）。前置胎盘（C错）典型症状是妊娠晚期或者临产时，发现无明显诱因、无痛性反复阴道流血，腹部检查子宫软，无压痛（P127）。先兆子宫破裂（D错）时会出现病理性缩腹环，可见该环逐渐上升达脐平或脐上，压痛明显（P218）。先兆早产（E错）指有规则或不规则宫缩，伴有宫颈管的进行性缩短（P59）。